与抗菌药配伍使用后，能增强抗菌药疗效的药物称为抗菌增效剂。属于抗菌增效剂的药物是
A. 氨苄西林
B. 舒它西林
C. 甲氧苄啶
D. 磺胺嘧啶
E. 氨曲南

正确答案：C。甲氧苄啶

解析：本题考查抗菌增效剂。甲氧苄啶（C对）能阻断二氢叶酸还原成四氢叶酸，与磺胺类药物合用，可产生协同的抗菌作用。磺胺嘧啶（D错）为磺胺类药物。氨苄西林（A错）为半合成的广谱青霉素，属氨基青霉素类。舒它西林（B错）为青霉烷砜类药物，能够抑制β-内酰胺酶。氨曲南（E错）是单环-内酰胺类抗菌药。